镇静、催眠药物，长期服用极易导致药物依赖
A. 地西泮
B. 苯巴比妥
C. 西地兰
D. 三唑仑
E. 水合氯醛

正确答案：D。三唑仑